患者，女，因流产失血过多，导致月经不调，久不怀孕。其病在哪经
A. 阴跷脉、阳跷脉
B. 阴维脉、阳维脉
C. 督脉、任脉
D. 冲脉、任脉
E. 阴跷脉、阴维脉

正确答案：D。冲脉、任脉

解析：该题考查奇经八脉的主要机能。冲脉能调节十二经脉气血，与女子月经及孕育机能有关，任脉能调节阴脉气血，主胞胎，故月经及孕育与冲任关系密切。因流产失血过多，导致月经不调，久不怀孕，其病在冲任（D对）。